大脑镰
A. 伸入大脑纵裂
B. 由硬脑膜内、外两层贴合形成
C. 于小脑幕的结合处有下矢状窦
D. 上缘内有横窦
E. 无

正确答案：A。伸入大脑纵裂

解析：大脑镰为硬脑膜形成的结构，伸入大脑纵裂（A对），分隔两大脑半球。由硬脑膜内、外两层贴合形成的结构称为硬脑膜窦（B错），其中包括上、下矢状窦、直窦、横窦、海绵窦等。大脑镰与小脑幕连接处的硬脑膜窦为直窦（C错）。大脑镰上缘内的硬脑膜窦为上矢状窦（D错）。